男，6个月，确诊有结核性脑膜炎，不符合该患儿脑脊液检查的是
A. 白细胞轻度升高
B. 淋巴细胞升高为主
C. 蛋白升高
D. 糖降低
E. 中性粒细胞升高为主

正确答案：E。中性粒细胞升高为主

解析：结核性脑膜炎时淋巴细胞增高，脑脊液检查时表现为白细胞数增多（50～500）×10⁶ /L（A对），分类以淋巴细胞为主（B对）（E错，为本题正确答案），糖和氯化物的均降低为结脑的典型改变（D对），蛋白量增高（C对）。